行乳腺癌内分泌治疗时，下述最重要的依据是
A. 病理分期
B. 脱落细胞学检查
C. 有无转移
D. 激素水平
E. ER、PR

正确答案：E。ER、PR